豨莶草除祛风通络外，又能
A. 清热解毒
B. 利水消肿
C. 杀虫解毒
D. 化痰解毒
E. 补肺止咳

正确答案：A。清热解毒

解析：本题考查豨莶草的功效。豨莶草除祛风通络外，又能清热解毒（A对）。豨莶草【功效】祛风湿，通经络，清热解毒，降血压。郁李仁【功效】润肠通便，利水消肿（B错）。雷公藤【功效】祛风除湿，活血通络，消肿止痛，杀虫解毒（C错）。丝瓜络【功效】祛风通络，化痰解毒（D错）。鹿衔草【功效】祛风湿，强筋骨，调经止血，补肺止咳（E错）。